缩窄性心包炎最有特异性的体征是
A. 奇脉
B. Ewart征
C. 心包叩击音
D. 肝大
E. 水肿

正确答案：C。心包叩击音

解析：心包叩击音在病人在胸骨左缘第3~4肋间可闻及，发生在第二心音后，呈拍击样，因舒张期血流突然涌入舒张受限的心室引起心室壁振动产生的额外心音，常见于心包积液和缩窄性心包炎时，是心包填塞的重要体征之一（C对）。奇脉（A错）不常见。Ewart征（B错）常出现在有心包积液时。肝大（D错）、水肿（E错）可出现在体循环障碍，但没有特异性。